因为存在与CYP2C19相关的相互作用，使用氯吡格雷时应避免合用的药物是
A. 阿托伐他汀
B. 格列齐特
C. 贝那普利
D. 布洛芬
E. 奥美拉唑

正确答案：E。奥美拉唑

解析：本题考查药物的相互作用。奥美拉唑（E对）既是CYP2C19的底物，又是CYP2C19强抑制剂，氯吡格雷体内经CYP2C19代谢发挥抗血小板作用，两者同服，会降低氯吡格雷的疗效；阿托伐他汀（A错）主要被肝药酶CYP3A4代谢，它可与CYP3A4抑制剂发生相互作用，抑制他汀类药的代谢，使他汀类药的血药浓度升高，发生肌毒性的风险增加；格列齐特（B错）应慎与西咪替丁、咪康唑、利福平和圣约翰草提取物合用，这些药物能影响格列齐特的降糖作用；布洛芬（D错）长期大剂量使用，会降低阿司匹林对心血管的保护作用；贝那普利（C错）属血管紧张素转化酶抑制剂（ACEI），心力衰竭患者同时服用水杨酸盐会降低ACEI的有效性。